关于NSAIDs类药物所致不良反应的说法，正确的是
A. NSAIDs类药物所致的胃肠道不良反应中，以萎缩缩性胃炎最为常见
B. 非选择性NSAIDs类药物可导致胃及十二指肠溃疡和出血等风险
C. 选择性COX-2抑制剂导致胃及十二指肠溃疡和出血的风险高于非选择性NSAIDs类药物
D. 非选择性NSAIDs类药物导致的心血管风险高于选择性COX-2抑制剂
E. 选择性COX-2抑制剂不易发生胃肠道及心血管方面的不良反应

正确答案：B。非选择性NSAIDs类药物可导致胃及十二指肠溃疡和出血等风险

解析：本题考查NSAIDs。非选择性NSAIDs类药物可导致胃及十二指肠溃疡和出血等风险（B对）；NSAIDs类药物所致的胃肠道不良反应中，以胃溃疡和十二指肠溃疡最为常见（A错）；选择性COX-2抑制剂可避免胃肠道的损害，故非选择性NSAIDs类药物导致胃及十二指肠溃疡和出血的风险高于选择性COX-2抑制剂（C错）；选择性COX-2抑制剂能抑制血管内皮的前列腺素生成，促进血栓形成，因此其导致心血管风险高于非选择性NSAIDs类药物（D错）；选择性COX-2抑制剂易发生胃肠道及心血管方面的不良反应（E错）。